消化性溃疡，常表现
A. 慢性规律性的上腹痛
B. 无规律性的上腹痛
C. 右上腹绞痛
D. 左上腹剧痛
E. 全腹剧痛

正确答案：A。慢性规律性的上腹痛

解析：消化性溃疡，常表现慢性规律性的上腹痛（A对）。无规律性上腹痛考虑为慢性胃炎等（B错）。右上腹绞痛考虑胆道结石（C错）。左上腹剧痛可考虑脾破裂（D错）。全腹剧痛考虑弥漫性腹膜炎（E错）。